麻醉同侧下颌第二前磨牙及磨牙颊侧牙龈、黏骨膜、颊部黏膜、颊肌和皮肤
A. 眶下神经阻滞麻醉
B. 颊长神经阻滞麻醉
C. 鼻腭神经阻滞麻醉
D. 舌神经阻滞麻醉
E. 腭前神经阻滞麻醉

正确答案：B。颊长神经阻滞麻醉

解析：颊（颊长）神经阻滞麻醉区域及效果：同侧下颌第二前磨牙及磨牙颊侧牙龈、黏骨膜、颊部黏膜、颊肌和皮肤。局部可有肿胀、麻木感。掌握“颌面部常用局麻法及牙拔除的麻醉选择”知识点。